制备小青龙颗粒，方中法半夏、干姜的提取采用
A. 浸渍法
B. 煎煮法
C. 渗漉法
D. 溶解法
E. 水蒸气蒸馏法

正确答案：C。渗漉法

解析：本题考查的是小青龙颗粒的制法。制备小青龙颗粒，方中法半夏、干姜的提取采用渗漉法（C对）。小青龙颗粒【制法】细辛、桂枝提取挥发油，蒸馏（E错）后的水溶液另器收集；药渣与白芍、麻黄、五味子、炙甘草加水煎煮（B错）两次，第一次2h，第二次1.5h，合并煎液，滤过，滤液与蒸馏后的水溶液合并，浓缩至约1000mL；法半夏、干姜粉碎成粗粉，按渗漉法，用70%乙醇作溶剂，浸渍24h后进行渗漉，收集渗漉液，回收乙醇，与上述药液合并，静置，滤过，滤液浓缩至适量，喷雾干燥，加乳糖适量，混匀，喷加细辛和桂枝的挥发油，混匀，制成颗粒461.5g；或滤液浓缩至相对密度为1.35～1.38（80℃）的清膏，加人蔗糖粉适量，混匀制成颗粒，干燥，喷加细辛和桂枝的挥发油，混匀，制成1000g，即得。